肾上腺素的临床应用包括
A. 支气管哮喘
B. 心律失常
C. 过敏性休克
D. 重症肌无力
E. 心脏骤停

正确答案：A、C、E。支气管哮喘；过敏性休克；心脏骤停

解析：本题考查肾上腺素的临床应用。肾上腺素的临床应用：①心搏骤停（E对）；②过敏性休克（C对）；③支气管哮喘（A对）；④局部止血；⑤与局麻药配伍及局部止血；⑥血管神经性水肿及血清病；⑦治疗青光眼。